除另有规定外，应进行溶出度检查的颗粒剂是
A. 泡腾颗粒
B. 肠溶颗粒
C. 水溶颗粒
D. 混悬颗粒
E. 酒溶颗粒

正确答案：D。混悬颗粒

解析：本题考查混悬颗粒的质量要求。混悬颗粒系指难溶性原料药物与适宜辅料混合制成的颗粒剂。临用前加水或其他适宜的液体振摇即可分散成混悬液。除另有规定外，混悬颗粒剂（D对）应进行溶出度检查。泡腾颗粒（A错）系指含有碳酸氢钠和有机酸，遇水可放出大量气体而呈泡腾状的颗粒剂。泡腾颗粒中的药物应是易溶性的，加水产生气泡后应能溶解。有机酸一般用枸橼酸、酒石酸等。肠溶颗粒系指采用肠溶材料包裹颗粒或其他适宜方法制成的颗粒剂。肠溶颗粒（B错）应进行释放度检查。可溶颗粒又可分为水溶颗粒（C错）和酒溶颗粒（E错）。